造成牙周病的最直接因素是
A. 牙石
B. 牙菌斑
C. 遗传因素
D. 内分泌因素
E. 全身疾病

正确答案：B。牙菌斑

解析：牙菌斑是牙周病的始动因素，即牙菌斑是导致牙周病的最直接因素，而牙石、牙面着色、食物嵌塞、（牙合）创伤、解剖因素、不良习惯、医源性因素等都属于牙周病的局部促进因素，并非导致牙周病的直接因素。而遗传因素、内分泌因素和全身疾病等是属于牙周病的全身易感因素。掌握“牙周炎病因学”知识点。